当正常人心率超过180次/分时，心排出量减少的原因主要是以下哪一时相缩短
A. 心房收缩期
B. 等容收缩期
C. 减慢射血相
D. 快速充盈相
E. 减慢充盈相

正确答案：D。快速充盈相